原核生物参与转录起始的酶是
A. 解链酶
B. 引物酵
C. RNA聚合酶Ⅲ
D. RNA聚合酶全酶
E. RNA聚合酶核心酶

正确答案：D。RNA聚合酶全酶